5，7-二甲氧基黄酮的
A. -H-NMR中化学位移在12.50左右有吸收
B. -H-NMR中H-8比-H-6在较低场有吸收
C. H-NMR中A环上没有芳香质子
D. -H-NMR中A环具有一个芳香质子
E. H-NMR中A环质子具有ABX偶合系统

正确答案：B。-H-NMR中H-8比-H-6在较低场有吸收